28岁，初孕妇。孕32周，因全身水肿及头痛来诊，妊娠前即有面部及下肢水肿，查血压21.3/14.7kPa（160/110mmHg），尿液检查常规蛋白（+++），可见颗粒管型及红细胞。经治疗孕37周自然分娩，产后6周，血压降至17/10kPa（128/75mmHg），尿蛋白（++），水肿（+）。下列诊断以哪种可能性大
A. 子痫前期
B. 妊娠合并肾炎
C. 慢性肾炎基础上并发子痫前期
D. 妊娠合并慢性高血压
E. 原发性高血压基础上并发子痫前期

正确答案：C。慢性肾炎基础上并发子痫前期

解析：C答案的基础疾病是慢性肾炎，A答案的基础疾病是原发性高血压。蛋白尿、血尿、高血压、水肿为慢性肾小球肾炎的临床表现。本例“孕32周。因全身水肿及头痛来诊，妊娠前即有面部及下肢水肿，查血压21.3/14.7kPa（160/110mmHg），尿液检查常规蛋白（+++），可见颗粒管型及红细胞。”均符合慢性肾小球肾炎的临床表现及实验室检查。血压高于160/110mmHg；尿蛋白高于5.0/24h或（+++）；血肌酐高于106μmol/L；血小板低于100×109/L；持续性头痛或视觉障碍；持续性上腹疼痛，肝包膜下血肿或肝破裂症状。“产后6周，血压降至17/10kPa（128/75mmHg），尿蛋白（++），水肿（+）。”题中所给临床表现及检查符合子痫前期重度的临床表现。因为题干中提示“妊娠前即有面部及下肢水肿”，故本题诊断为慢性肾炎基础上并发子痫前期。掌握“娠期高血压疾病”知识点。